土壤中镉的卫生标准是1.0ppm，经调查研究认为某地土壤环境镉的环境容量是0.6ppm，请问该环境单元的镉的自然背景值是多少
A. 0.1
B. 0.2
C. 0.3
D. 0.4
E. 0.6

正确答案：D。0.4

解析：本题考查自然背景值。土壤中镉的卫生标准是1.0ppm，表明土壤中镉的最大容量是1.0ppm，超过这个数值就会对人体健康造成危害。本题某地土壤环境镉的环境容量是0.6ppm，表明在不受人为污染的情况下，该地土壤环境可以承受的最大镉容量是0.6ppm。因此，可以得出该环境单元的镉的自然背景值是0.4ppm（D对ABCE错）。